我国细菌性痢疾主要流行菌群是
A. 宋内志贺菌
B. 痢疾志贺菌
C. 福氏志贺菌
D. 鲍氏志贺菌
E. 产志贺毒素大肠杆菌

正确答案：C。福氏志贺菌

解析：志贺菌血清型繁多，根据生化反应和O抗原不同，将志贺菌分为4个血清群（即痢疾志贺菌，福氏志贺菌，鲍氏志贺菌，宋内志贺菌，又依次称为A、B、C、D群）我国以福氏志贺菌（C对）和宋内志贺菌占优势。福氏志贺菌感染易转化为慢性；宋内志贺菌（A错）感染引起症状轻，多呈不典型发作；痢疾志贺菌（B错）毒力最强，可引起严重症状。